血浆胶体渗透压的生理作用是
A. 调节细胞内外水的交换
B. 调节血管内外水的交换
C. 维持细胞正常体积
D. 维持细胞正常形态
E. 决定血浆总渗透压

正确答案：B。调节血管内外水的交换